患者，男，58岁，COPD稳定期，接受吸入剂治疗后出现口干，可能引起这一反应的药物是
A. 福莫特罗
B. 布地奈德
C. 茶碱
D. 噻托溴铵
E. 沙丁胺醇

正确答案：D。噻托溴铵

解析：本题考查噻托溴铵。噻托溴铵（D对）为长效的抗胆碱药，抗胆碱药的不良反应主要有口干、便秘、心率加快等。福莫特罗（A错）为长效β₂受体激动剂（LABA），长期单独使用LABA有增加哮喘患者死亡的风险，故不推荐长期单独使用LABA。布地奈德（B错）是吸入性糖皮质激素，通常需要吸入1～2周以上方能见效，因其会出现口咽白色念珠菌感染、声音嘶哑症状，吸药后用清水漱口可以有效缓解局部反应和胃肠吸收。茶碱（C错）的不良反应表现为恶心、呕吐、头痛、不安、失眠及易激动，严重时可出现心前区不适、心悸、心律失常或呼吸不规则，甚至可有室性心动过速、精神失常、惊厥、癫痫发作、昏迷，甚至呼吸和心脏骤停。β₂受体激动剂沙丁胺醇（E错）的主要不良反应是骨骼肌震颤、低血钾、心律紊乱。